某地某年男性简略寿命表中0岁组的期望寿命为70.1岁，则1岁组的期望寿命
A. 大于70.1岁
B. 小于70.1岁
C. 不一定
D. 大于等于70.1岁

正确答案：C。不一定

解析：本题考查期望寿命。某地某年男性简略寿命表中0岁组的期望寿命为70.1岁，则1岁组的期望寿命不一定（C对ABD错）。如果0岁组的死亡率很低，则1岁组的期望寿命会大于70.1岁；如果0岁组的死亡率很高，则1岁组的期望寿命就会小于70.1岁。